某中学体检时，发现有少数考生口角有轻度溃疡，怀疑是某种维生素缺乏，为确诊建议进一步检查的项目是
A. 红细胞转酮醇酶活力
B. 红细胞谷胱甘肽还原酶活性系数
C. 红细胞溶血试验
D. 2-吡啶酮
E. 白细胞中维生素B₂

正确答案：B。红细胞谷胱甘肽还原酶活性系数